女性56岁，结节性甲状腺肿伴甲亢，首选何种治疗
A. 硫脲类制剂
B. 碘制剂
C. 普萘洛尔
D. ¹³¹I
E. 手术

正确答案：E。手术

解析：患者中年女性，结节性甲状腺肿伴甲亢，多为继发性结节，先有结节性甲状腺肿，再出现甲亢症状。继发性甲亢的治疗为手术（E对）。硫脲类制剂（A错）为抗甲状腺药物，适用于轻、中度病情；甲状腺轻、中度肿大；孕妇及高龄或其他不适宜手术者；手术前和¹³¹I治疗前的准备。碘制剂（B错）多用于手术前的辅助性治疗。普萘洛尔（C错）是针对手术前心率快者所使用的治疗。¹³¹I（D错）适用于甲状腺肿大Ⅱ度以上，对ATD过敏；ATD治疗或手术后复发；甲亢合并心脏病；甲亢伴白细胞、血小板、或全血细胞减少者。